有关视神经盘(视神经乳头)的叙述正确的是
A. 位于眼球后极
B. 位于黄斑颞侧稍下方区域
C. 此处无感光细胞，称生理性盲点
D. 是视力最敏锐的部位

正确答案：C。此处无感光细胞，称生理性盲点

解析：视神经盘位于眼球后方偏鼻侧，而非眼球后极（A错），位于黄斑鼻侧稍下方区域，而非黄斑颞侧下方（B错）。视神经盘有视网膜中央动、静脉走行，且无感光细胞，故为生理性盲点（C对）。视力最敏锐的部位（D错）是黄斑，而非视神经盘。